躯体疾病所致精神障碍处理原则，错误的是
A. 首先必须治疗引起精神障碍的原发躯体疾病
B. 支持疗法包括维持水电解质平衡、充足的营养供应等
C. 护理包括安静、安全的环境和防止意外发生等
D. 对精神症状的控制应遵从大剂量、足疗程的原则
E. 要考虑治疗药物对患者的副作用

正确答案：D。对精神症状的控制应遵从大剂量、足疗程的原则

解析：躯体疾病所致精神障碍是由脑以外的躯体疾病，如躯体感染、内脏器官疾病、内分泌障碍、营养代谢疾病等，引起脑功能紊乱而产生的精神障碍。躯体疾病的支持治疗是维持水电解质平衡，充足的营养供应等支持治疗（B对），加强脑保护治疗，采取安静，安全的环境和防止意外发生等护理措施（C对）。躯体疾病还需要控制患者精神症状，因年龄、躯体疾病、药物间的相互作用等原因，对于躯体疾病所致精神障碍的患者，使用精神药物要慎重，起始剂量应更低，剂量应逐渐增加，当症状稳定时，应考虑逐渐减少剂量，同时要考虑治疗药物对病人的副作用（E对），不应遵从大剂量，足疗程的原则（D错，为本题正确答案）。躯体疾病的病因治疗是首先必须治疗引起精神障碍的原发躯体疾病（A对），停用可能引起精神障碍的药物等。